采用背俞穴治疗皮肤痒疹，应首选
A. 肝俞
B. 肺俞
C. 脾俞
D. 三焦俞
E. 心俞

正确答案：B。肺俞

解析：肺俞主治咳嗽、气喘、咯血等肺疾；骨蒸潮热、盗汗等阴虚病症；瘙痒、瘾疹等皮肤病（B对）。